易于导致干咳少痰，或痰黏难咯，甚或喘息胸痛等症的邪气是
A. 风邪
B. 寒邪
C. 暑邪
D. 湿邪
E. 燥邪

正确答案：E。燥邪

解析：本题考察六淫邪气致病特点。因肺为娇脏，喜润而恶燥，燥易伤肺，耗伤肺津，影响肺气宣降，甚及损伤肺络，因此出现了干咳少痰，或痰黏难咯，甚或喘息胸痛的表现（E对）。